紫金锭是著名的祛暑辟秽成药，功能辟瘟解毒、消肿止痛，其主治有
A. 乳岩
B. 痄腮
C. 丹毒
D. 喉风
E. 疔疮疖肿

正确答案：B、C、D、E。痄腮；丹毒；喉风；疔疮疖肿

解析：本题考查的是紫金锭的主治。紫金锭是著名的祛暑辟秽成药，功能辟瘟解毒、消肿止痛，其主治有痄腮（B对）、丹毒（C对）、喉风（D对）与疔疮疖肿（E对）。紫金锭：【主治】中暑，脘腹胀痛，恶心呕吐，痢疾泄泻，小儿痰厥；外治疔疮疖肿，痄腮，丹毒，喉风。牛黄醒消丸：【主治】热毒郁滞、痰瘀互结所致的痈疽发背、瘰疬流注、乳痈乳岩（A错）、无名肿毒。